一般情况下，左心室冠脉血流量在收缩期的血流量约为舒张期的20%～30%，可影响冠脉血流量的主要因素是
A. 脉压大小
B. 平均动脉压高低
C. 心脏搏出量多少
D. 舒张压的高低和心舒期的长短
E. 收缩压的高低和射血期的长短

正确答案：D。舒张压的高低和心舒期的长短